钉洞固位形的深度一般为
A. 1mm
B. 1.5mm
C. 2mm
D. 2.5mm
E. 3mm

正确答案：B。1.5mm

解析：本题考查钉洞固位形的深度。钉洞固位形是一种比较好的固位形，固位力的大小与深度有关，一般深1.5mm（B对）到达牙本质层，可获得足够固位力；根据需要可增加至2mm（C错），若为活髓牙，前提是不伤及牙髓，但这是在1.5mm深度不够的情况下。若过浅（A错）则固位力不足，过深（DE错）会降低牙齿抗力，甚至伤及牙髓。